开放性骨折处理正确的是
A. 用毛刷洗刷创口内污染的骨质
B. 失去活力的大块肌肉组织可以部分保留
C. 已污染的骨膜应完全切除
D. 游离污染的小骨片应该去除
E. 不能切除创口的边缘

正确答案：D。游离污染的小骨片应该去除

解析：开放性骨折的处理原则是及时正确地处理创口，尽可能地防止污染，力争将开放性骨折转化为闭合型骨折。清创的原则：①切除创缘皮肤1～2mm（E错），清除异物，切除污染和失去活力的皮下组织、筋膜、肌肉（B错），尽量保留肌腱、神经和血管的完整性以便修复。②骨外膜应尽量保留，以保证骨愈合。若已污染，可仔细将其表面切除（C错）。③粉碎性骨折的骨片应仔细处理，游离骨片（D对），无论大小，都应去除；较大骨片去除后形成的骨缺损应行植骨术；与周围组织尚有联系的骨片应予保留并复位，以利骨折愈合。④密质骨的污染可用骨凿凿除或用骨钳咬除，污染的松质骨可以刮除，污染的骨髓腔应注意将其彻底清除干净。毛刷一般用于创口表面皮肤的清洗，不能进入创口深处的骨质（A错）。